特异质反应是指
A. 在剂量过大或药物在体内蓄积过多时发生的不良反应
B. 停药后血药浓度已降至阈浓度以下时残存的药理效应
C. 突然停药后原有疾病加剧
D. 反应性质与药物原有效应无关，用药理性拮抗药解救无效
E. 一类先天遗传异常所致的反应

正确答案：E。一类先天遗传异常所致的反应